下颌下腺开始发育为
A. 成人
B. 12岁
C. 在3～4岁
D. 胚胎第6周
E. 胚胎第6周末

正确答案：E。胚胎第6周末

解析：本题考查唾液腺的发育。下颌下腺开始发育为胚胎第6周末（E对）。腮腺导管开口的位置随个体发育而稍有变化。成人（A错）时腮腺导管开口位于上颌第二恒磨牙相对的颊黏膜处。在12岁（B错）时腮腺导管开口位于上颌第一恒磨牙相对的颊黏膜处。在3～4岁（C错）时腮腺导管开口位于上颌第二乳磨牙相对的颊黏膜。腮腺在胚胎第6周（D错）开始发育。